某些药物促进自身或其它合用药物代谢的现象属于
A. 酶诱导作用
B. 膜动转运
C. 血脑屏障
D. 肠肝循环
E. 蓄积作用

正确答案：A。酶诱导作用

解析：本题考查酶诱导作用。酶诱导作用（A对）是有些化学物质能提高肝药酶活性，增加自身或其它药物的代谢速率；膜动转运（B错）是通过膜主动变形，来吞没液滴或微粒，将某些物质摄入细胞内或从细胞内释放到细胞外；血脑屏障（C错）是指血液与脑组织之间存在的屏障；肠肝循环（D错）是指随胆汁排入十二指肠的药物或其代谢物，在肠道中重新被吸收，经门静脉返回肝脏，重新进入血液循环的现象；蓄积作用（E错）指药物对某些组织亲和性不同，有些药物在组织中停留时间长，返回血液循环的速度慢，当连续应用该药物时，组织中的药物浓度逐渐升高。